正常人安静状态时出现的脑电波应为
A. α波
B. β波
C. γ波
D. δ波
E. θ波

正确答案：A。α波

解析：正常人安静状态时出现的脑电波应为α波（A对）。β波一般见于成人活动时（B错）。γ波一般出现于快速眼动睡眠时期（C错）。δ波一般出现在成人入睡后或处于极度疲劳或麻醉（D错）。θ波是成年人困倦时的主要脑电活动表现（E错）。